在发达国家，慢性二尖瓣关闭不全的最常见病因是
A. 风湿性心脏病
B. 结缔组织病
C. 二尖瓣粘液样变性
D. 感染性心内膜炎
E. 二尖瓣先天异常

正确答案：C。二尖瓣粘液样变性

解析：在欧美等发达国家，慢性二尖瓣关闭不全的最常见病因是二尖瓣黏液样变性（C对）；而在我国，慢性二尖瓣关闭不全的最常见病因是风湿性心脏病（A错），约占1/3。结缔组织病（B错）、感染性心内膜炎（D错）和二尖瓣先天异常（E错）也是引起慢性二尖瓣关闭不全的病因，但在发达国家的发生率都不如二尖瓣黏液样变性。